下列除哪项外，均可见于匙状指
A. 高原疾病
B. B缺铁性贫血
C. 风湿热
D. 甲癣
E. 尺神经损伤

正确答案：E。尺神经损伤

解析：匙状甲不见于尺神经损伤（E错，为本题正确答案）。尺神经损伤常表现为环、小指“爪形手”畸形，而匙状甲表现为指甲中央凹陷，边缘翘起，指甲变薄，表面粗糙有条纹，常见于高原疾病（A对）和缺铁性贫血（B对），偶见于风湿热（C对）和甲藓（D对）。